不属于常见的毒蕈中毒类型
A. 胃肠炎型
B. 溶血型
C. 神经精神型
D. 类伤寒型
E. 中毒性肝炎型

正确答案：D。类伤寒型

解析：常见的毒蕈中毒：①胃肠炎型；②神经精神型；③溶血型；④中毒性肝炎型毒草中毒。掌握“食品安全”知识点。